下颌下区红肿、压痛为主要表现的是
A. 颞下间隙感染
B. 眶下间隙感染
C. 翼下颌间隙感染
D. 咬肌间隙感染
E. 下颌下间隙感染

正确答案：E。下颌下间隙感染

解析：多数下颌下间隙感染是以下颌下淋巴结炎为其早期表现，临床表现为下颌下区丰满，检查有明确边界的淋巴结肿大、压痛。掌握“下颌下间隙、颊间隙感染”知识点。